某患者，竞争意识强，总想胜过他人，老觉得时间不够用，说话快，走路快，脾气暴躁，容易激动，常与他人意见不一致。其行为类型属于
A. A型行为
B. B型行为
C. C型行为
D. AB混合型行为
E. BC混合型行为

正确答案：A。A型行为

解析：A型行为模式表现为有较高的成就欲望，富于挑战和竞争精神，容易发生无端敌意，争强好胜，不耐烦，有时间紧迫感等，此题属典型A型行为（A对）。B型行为（B错）表现为特别有耐心的，谦虚的，放松的，有安全感的，有适当自尊的。C型行为第六版医学心理学未详细论述，查找资料得知，C型行为（C错）就是容易使人患癌症的心理行为模式，主要表现为过度压抑情绪，尤其是不良的情绪，如愤怒、悲伤等，不让它们得到合理的舒泄。